男，12岁。因注意力不集中、学习困难而求助心理治疗师。心理治疗师给他一些散乱的木块，要求其尽可能快地将这些木块拼成一个物件。这种心理测验属于
A. 言语测验
B. 操作测验
C. 问卷测验
D. 主管测验
E. 投射测验

正确答案：B。操作测验

解析：心理治疗师给他一些散乱的木块，要求其尽可能快地将这些木块拼成一个物件。这种心理测验属于操作测验（B对）。